表示某种现象发生的强度的是
A. 率
B. 构成比
C. 相对比
D. 变异系数
E. 标准差

正确答案：A。率

解析：率亦称频率指标，表示某现象发生的频度或强度。掌握“分类资料的统计描述与推断”知识点。